关于乳牙滞留的病因，下列说法错误的是
A. 继承恒牙萌出方向异常
B. 先天恒牙缺失
C. 乳牙根尖周病变
D. 恒牙牙胚位置远离乳牙牙根
E. 乳牙外伤

正确答案：E。乳牙外伤

解析：继承恒牙萌出方向异常，使乳牙牙根未吸收或吸收不完全。先天缺失恒牙可使乳牙根吸收缓慢造成滞留。乳牙根尖周病变破坏牙槽骨使恒牙早萌，而乳牙也可滞留不脱落。继承恒牙萌出无力，乳牙根不被吸收。恒牙牙胚位置远离乳牙牙根也可能使乳牙滞留。全身因素如颅骨锁骨发育不全。某些遗传因素致多个乳牙滞留。掌握“乳牙滞留和乳牙早萌”知识点。